尿路感染为脾肾亏虚、湿热屡犯证，治疗应首选的方剂是
A. 八正散
B. 丹栀逍遥散
C. 无比山药丸
D. 知柏地黄丸
E. 小蓟饮子

正确答案：C。无比山药丸

解析：尿路感染之脾肾亏虚、湿热屡犯证需健脾补肾，首选无比山药丸（C对）。膀胱湿热证需清热利湿通淋首选八正散加减（A错）。肾阴不足，湿热留恋证需滋阴益肾，清热通淋，首选知柏地黄丸（D错）加减。第十版书尿路感染中肝胆郁热证需疏肝理气，清热通淋，方用小柴胡汤合石韦散加减，不用丹栀逍遥散（B错）。小蓟饮子（E错）用于治疗血淋实证，以清热通淋，凉血止血。